突发环境污染事件对人群健康的危害有
A. 急性刺激作用
B. 急性中毒和死亡
C. 慢性、潜在性健康危害
D. 突发环境污染事件对人群心理的影响
E. 以上都是

正确答案：E。以上都是